女，22岁，因服吲哚美辛数片后觉胃痛，今晨呕咖啡样胃内容物400ml来诊。既往无胃病史。首选的检查是
A. 血清胃泌素测定
B. B型超声检查
C. X线胃肠钡餐
D. 急诊胃镜检查
E. 胃液分析

正确答案：D。急诊胃镜检查

解析：青年女性，既往无胃病史，服用非甾体类抗炎药后出现呕血症状，首选检查是急诊胃镜（D对）。B型超声检查对被气体遮盖的组织探查受限，故对胃部疾病诊断意义不大（B错）。X线胃肠钡餐可用于不愿接受或不能耐受胃镜检查者（C错）。胃液分析及血清胃泌素测定有助于胃泌素瘤的诊断（A错）。